深Ⅱ度烧伤创面处理不正确的是
A. 1：2000氯已定清洗创面，去除异物
B. 去除水泡皮
C. 油质纱布包扎创面
D. 面部创面不包扎
E. 创面使用抗菌素预防全身感染

正确答案：E。创面使用抗菌素预防全身感染

解析：轻度烧伤（轻度烧伤患者可出现深Ⅱ度烧伤）的创面处理包括清洁创周健康皮肤，创面可用1：1000苯扎溴铵或1：2000氯己定清洗，移除异物（A对），浅Ⅱ°水疱皮应予保留，水疱大者，可用消毒空针抽去水疱液。深度烧伤的水疱皮应予清除（B对）。如果用包扎疗法，内层用油质纱布（C对），可添加适量抗生素，外层用吸水敷料均匀包扎，包扎范围应超过创周5cm。面、颈与会阴部烧伤不适合包扎处，则给予暴露疗法（D对）。按八版外科学观点，本题无正确答案。七版外科学P183认为烧伤创面一般可不用抗生素预防感染（E错，为本题正确答案）。